最多可能表达的HLA-I类分子有几种
A. 1
B. 2
C. 3
D. 4
E. 5

正确答案：C。3

解析：MHC为主要组织相容性复合体，人的MHC称为HLA。HLA结构复杂，传统上分为I类、Ⅱ类和免疫功能相关基因。其中HLA-I类最多可表达3种（C对），即HLA-A、HLA-B和HLA-C。